五行之中，其特性为“炎上”的是
A. 木
B. 金
C. 火
D. 水
E. 土

正确答案：C。火

解析：炎上，指具有炎热、上升、光明的特性， 引申为具有温热、上升、光明等性质或作用的事物和现象，归属于火（C对）； 木，引申为具有生长、升发、条达、舒畅等性质或作用的事物和现象 （A错）；金，引申为凡有沉降、肃杀、收敛等性质或作用的事物和现象（B错）；水，引申为具有滋润、下行、寒凉、闭藏等性质或作用的事物和现象（D错）。